下列不属于弦脉所主的病证是
A. 诸痛
B. 疟疾
C. 痰饮
D. 胃热
E. 肝郁

正确答案：D。胃热

解析：寒热诸邪、疼痛（A对）、痰饮（C对）等，均可使肝失条达，气机阻滞，阴阳不和，脉气因而紧张，故脉可强硬而弦。若疟邪（B对）侵入，伏于半表半里，少阳枢机不利亦可见弦脉，如《金匮要略》谓“疟脉自弦”。肝主疏泄，调畅气机，以柔和为贵。若情志不遂，肝气郁结（E对），疏泄失常，气郁不利致经脉拘束则见弦脉。洪脉多见于阳明气分热盛（D错，为本题正确答案）。